男性，55岁。双下肢无力半年，右侧明显，近2个月行走不稳，右手不能扣纽扣。无外伤史，无发热。体格检查，颈背部无明显压痛，两上肢前臂、手及上臂尺侧皮肤感觉减退，右侧尤其明显，四肢肌张力增高。肱二头肌反射亢进，双侧膝踝反射亢进，右髌阵挛阳性，右侧巴彬斯基征阳性。应考虑的治疗是
A. 颈枕吊带牵引
B. 激素治疗
C. 推拿按摩治疗
D. 手术
E. 颈托围领

正确答案：D。手术

解析：中年男性（颈椎病的好发年龄），双下肢无力半年，右侧明显，近2个月行走不稳，右手不能扣纽扣（提示四肢运动障碍，双手精细动作障碍）。体格检查：两上肢前臂、手及上臂尺侧皮肤感觉减退，右侧尤其明显，四肢肌张力增高。肱二头肌反射亢进（提示颈髓5～6节受压），双侧膝踝反射亢进，右髌阵挛阳性，右侧巴彬斯基征阳性。综合该患者的临床症状、体征考虑该患者最可能的诊断为颈椎病（脊髓型）。颈椎病的治疗包括非手术治疗和手术治疗，该患者脊髓或神经根明显受压，伴有神经功能障碍符合手术治疗指征（D对）。颈枕吊带牵引（A错）、推拿按摩治疗（C错）、颈托围领（E错）属于非手术治疗。激素治疗（B错）可以缓解患者疼痛，但不能根治。